按痢疾杆菌抗原结构和生化反应可分为
A. 4群
B. 5群
C. 3群
D. 1群
E. 2群

正确答案：A。4群

解析：痢疾杆菌属于肠杆菌科志贺菌属，按照抗原结构和生化反应的不同分为4群（A对）。宋氏志贺菌抵抗力最强，福氏志贺菌次之，痢疾志贺菌最弱。目前我国流行的优势菌群为福氏志贺菌和宋氏志贺菌，所有痢疾杆菌均可产生内毒素，引起全身严重反应如发热、毒血症及休克等。